原发于口底黏膜的癌
A. 舌癌
B. 颊癌
C. 皮肤癌
D. 口底癌
E. 中央性颌骨癌

正确答案：D。口底癌

解析：口底癌系指原发于口底黏膜的癌，与来自舌下腺的癌应有所区别。掌握“颊癌、口底癌及唇癌”知识点。